下列哪项不属于计划实施的过程评价指标
A. 项目活动执行率
B. 干预活动覆盖率
C. 未参与干预活动的人数
D. 目标人群满意度
E. 活动费用使用率

正确答案：C。未参与干预活动的人数